饥不欲食可见于
A. 胃火亢盛
B. 胃强脾弱
C. 脾胃湿热
D. 胃阴不足
E. 肝胃蕴热

正确答案：D。胃阴不足

解析：胃阴不足，虚火内扰，则有饥饿感；阴虚失润，胃之腐熟功能减退，故不欲食（D对）。消谷善饥，兼多饮多尿，形体消瘦者，多见于消渴病。因胃火亢盛，腐熟太过所致（A错）。消谷善饥，兼大便溏泻者，属胃强脾弱（B错）。脾胃湿热可致口甜或口黏腻，因甜味入脾，湿热蕴结脾胃，浊气上泛于口所致（C错）。肝胃蕴热可致口中泛酸，多因酸味入肝，肝热之气上蒸于口所致（E错）。